关于腹壁紧张度增加的描述哪项不妥
A. 全腹壁紧张见于肠胀气
B. 全腹壁紧张见于大量腹水
C. 急性弥漫性腹膜炎多出现板状腹
D. 全腹壁紧张见于脱水之患者
E. 结核性炎症腹壁有柔韧感

正确答案：D。全腹壁紧张见于脱水之患者

解析：腹壁紧张度增加不见于脱水患者，脱水患者表现为全腹凹陷（D错，为本题正确答案）。肠胀气是由于多种原因引起的，胃肠道不通畅或梗阻引起胃肠道的气体不能随胃肠蠕动排出体外，气体集聚于胃肠道就会有胀气感，故表现为全腹壁紧张（A对）。病理状态下导致腹腔内液体量增加，超过200mL时称为腹腔积液，故全腹壁紧张见于大量腹水（B对）。突发而剧烈的刺激，胃酸和胆汁这种化学性的刺激，可引起强烈的腹肌紧张，故急性弥漫性腹膜炎多出现板状腹（C对）。结核性炎症腹壁有柔韧感（E对）。